可能导致牙龈增生的药物是
A. 拉西地平
B. 依诺肝素
C. 普伐他汀
D. 普萘洛尔
E. 呋塞米

正确答案：A。拉西地平

解析：本题考查拉西地平的不良反应。可能导致牙龈增生的药物是拉西地平（A对）。拉西地平为二氢吡啶类钙通道阻滞剂，二氢吡啶类钙通道阻滞剂常见不良反应包括：反射性交感神经激活导致心跳加快、面部潮红、脚踝部水肿、牙龈增生等。依诺肝素（B错）为抗凝剂，常见不良反应有出血、血小板减少症、增加血中某些酶的水平（转氨酶）等。普伐他汀（C错）为他汀类调血脂药，常见不良反应有胃肠道反应、肌痛、横纹肌溶解症、肝脏氨基转移酶AST及ALT升高等。普萘洛尔（D错）常见窦性心动过缓、房室传导阻滞、低血压，诱发及加重心力衰竭、加剧降糖药的降血糖作用，并掩盖低血糖症状等。呋塞米（E错）为高效利尿药，常见不良反应有耳毒性、高尿酸血症、水与电解质紊乱等。